疾病的分布可分为人群分布，地区分布及时间分布，下列哪一项不属于人群分布
A. 性别
B. 家庭
C. 季节
D. 职业

正确答案：C。季节

解析：本题考查三间分布中的人群分布。人群分布是指人群的一些固有特征或社会特征可构成疾病或健康状态的人群特征，这些特征包括：年龄、性别（A对）、职业（D对）、种族和民族、婚姻与家庭（B对）、行为生活方式、宗教信仰、人口流动等。季节（C错，为本题正确答案）属于时间分布。